关于肾的冠状切面正确的描述是
A. 可见锥形的肾锥体，尖向皮质
B. 肾锥体与肾柱构成肾髓质
C. 皮质位居肾实质的表层，无血管故色淡（新鲜标本上）
D. 肾窦向外缩细，延伸为肾盂
E. 每个肾小盏可包绕1－3个肾乳头

正确答案：E。每个肾小盏可包绕1－3个肾乳头

解析：肾锥体的尖向肾窦（A错）。肾柱（B错）伸入肾锥体之间的肾皮质，非髓质部分。肾皮质血管丰富，新鲜标本为红褐色（C错）。肾窦（D错）开口于肾门，而肾盂为肾窦的组成成分。肾乳头数量比肾小盏数量少，可见肾小盏可包绕多个肾乳头（E对）。